Schirmer试验滤纸的夹持时间是
A. 1分钟
B. 2分钟
C. 3分钟
D. 4分钟
E. 5分钟

正确答案：E。5分钟

解析：本题考查舍格伦综合征的诊断。Schirmer试验滤纸的夹持时间是5分钟（E对）。施默（Schirmer）试验用于检测泪腺分泌功能。用5mm×35mm的滤纸两条，置于睑裂内1/3和中1/3交界处，闭眼夹持5分钟后检查滤纸湿润长度，低于5mm则表明泪液分泌减少。